高血压治疗药物选择时，噻嗪类利尿剂慎用于
A. 心力衰竭患者
B. 痛风患者
C. 胃溃疡患者
D. 双侧肾动脉狭窄患者
E. 哮喘患者

正确答案：B。痛风患者

解析：本题考查药物的禁忌症。高血压治疗药物选择时，噻嗪类利尿剂慎用于痛风患者（B对）。心力衰竭患者（A错）禁用非二氢吡啶类钙通道阻滞药，如维拉帕米。胃溃疡患者（C错）禁用利血平。双侧肾动脉狭窄患者（D错）禁用ACEI、ARB类降压药。哮喘患者（E错）禁用β受体阻断剂，如普萘洛尔。